女，26岁。产后面色变红、肥胖1年半，乏力、头痛加重半年，并口渴多饮，夜间尿量达1700ml比白天多。查体：血压180/126mmHg、脉率104次/分，向心性肥胖，面色红黑有痤疮，皮肤薄乳晕及指关节伸侧色较深，腹壁胭窝及腋窝周围有紫纹，双下肢有可凹性水肿。为明确诊断应选择
A. CRH兴奋试验
B. 小剂量地塞米松抑制试验
C. 糖耐量试验
D. 螺内脂（安体舒通）试验
E. 24小时尿儿茶酚胺测定

正确答案：B。小剂量地塞米松抑制试验

解析：库欣综合征为各种病因造成肾上腺分泌过多糖皮质激素所致病症的总称。其血浆皮质醇分泌增多，失去昼夜节律，且不能被小剂量地塞米松抑制（P700）。地塞米松为人工合成的糖皮质激素中生物作用最强的激素之一，仅需要很小的剂量即能达到与天然皮质醇相似的作用，使用小剂量地塞米松可抑制正常人的皮质醇分泌，从而血皮质醇测定值减少，而库欣综合征却不受影响。因此小剂量地塞米松抑制试验可以用于诊断库欣综合征（B对）。CRH兴奋性试验（A错）主要用于腺垂体功能减退症及肾上腺皮质功能减退症的诊断（兴奋试验多用于分泌功能减退的情况，八版内科学P659）。糖耐量试验（C错）主要用于糖尿病的诊断。螺内酯试验（D错）主要用于诊断原发性醛固酮增多症。24小时尿儿茶酚胺测定（E错）主要用于诊断肾上腺嗜铬细胞瘤（P711）。